嗜酸性粒细胞增多不见于
A. 寄生虫病
B. 湿疹
C. 猩红热
D. 急性感染
E. 过敏反应

正确答案：D。急性感染